引起代谢性碱中毒的是
A. 过度饥饿
B. 摄入大量水杨酸制剂
C. 休克
D. 严重肝脏疾病
E. 原发性醛固酮增多症

正确答案：E。原发性醛固酮增多症

解析：原发性醛固酮增多症（E对）可刺激集合管泌氢细胞的H+-ATP酶（氢泵），促进H+排泌，也可通过保Na+排k+促进H+排泌，而造成低钾性碱中毒。过度饥饿（A错）大量动用脂肪供能引起酮症酸中毒；休克（C错）使细胞内糖的无氧酵解增强而引起乳酸增加，产生乳酸性酸中毒；严重肝脏疾病（D错）时尿素合成障碍常导致代谢性碱中毒，摄入大量水杨酸制剂（B错）使外源性固定酸摄入过多而引起代谢性酸中毒。